不属于左心室内的结构是
A. 肺动脉瓣
B. 主动脉瓣
C. 腱索
D. 乳头肌
E. 二尖瓣

正确答案：A。肺动脉瓣

解析：肺动脉瓣（A错，为本题正确答案）位于右心室流出道的肺动脉口周围的肺动脉瓣环上，是不属于左心室内的结构。